菱形窝位于
A. 脑桥和中脑的背侧面
B. 脑桥和中脑的腹侧面
C. 脑桥和延髓的腹侧面
D. 脑桥和延髓的背侧面
E. 小脑半球及蚓部的腹侧面

正确答案：D。脑桥和延髓的背侧面

解析：菱形窝位于脑桥和延髓的背侧面（D对）。